腮腺管开口于
A. 上颌第二磨牙处
B. 上颌第一磨牙处
C. 平对上颌第二磨牙牙冠的颊粘膜处
D. 平对上颌第一磨牙的颊粘膜处
E. 以上都不是

正确答案：C。平对上颌第二磨牙牙冠的颊粘膜处

解析：腮腺管开口于平对上颌第二磨牙牙冠的颊粘膜处(C对)的腮腺管乳头。